适宜清晨服用的是
A. 泼尼松龙
B. 奥利司他
C. 氟伐他汀
D. 多潘立酮
E. 吲哚美辛

正确答案：A。泼尼松龙

解析：本题考查药品服用的适宜时间。泼尼松龙（A对）是糖皮质激素类药物，清晨服用可减少对下丘脑-垂体-肾上腺皮质系统的反馈抑制。奥利司他（B错）是减肥药，进餐时服用。氟伐他汀（C错）适宜于睡前服用，因肝脏合成胆固醇峰期多在夜间，晚餐后服药有助于提高疗效。多潘立酮（D错）是促胃动力药，餐前服用以助消化。吲哚美辛（E错）适宜在餐后服用。